最早把“疳”列为脾胃病的儿科医家是
A. 万全
B. 薛铠
C. 刘昉
D. 董汲
E. 钱乙

正确答案：E。钱乙

解析：北宋钱乙重视小儿脾胃病的调理，著《小儿药证直决-诸疳》提出“疳皆脾胃病”（E对）。明代儿科世医万全著《育婴家秘》、《幼科发挥》、《痘疹心法》、《片玉心书》、《片玉痘疹》，倡导“育婴四法”（A错）。薛铠精于儿科，著《保婴撮要》，对中医小儿外科学的形成做出了重大贡献（B错）。刘昉编著《幼幼新书》（C错）。董汲擅用寒凉法治疗，撰写成《小儿斑疹备急方论》（D错）。